有关体细胞突变的后果，下面哪项是错误的
A. 可使体细胞发生不正常的分裂
B. 可使体细胞发生不正常的增生
C. 不具有传递性质
D. 是癌变的基础
E. 是致畸的基础

正确答案：C。不具有传递性质

解析：本题考查体细胞突变的后果。体细胞突变是指体细胞在遗传物质（DNA）水平上发生的变异，它可以使体细胞发生不正常的分裂（A对）和增生（B对），可能会导致癌症（D对）和致畸（E对）。体细胞突变具有传递性质（C错，为本题正确答案），即可以传递给下一代。